李某，女，24岁。突发寒战高热，咳嗽咳痰，右胸痛3天，予退热剂后出现大汗淋漓，头晕，眼花，心悸，速来急诊。查体：神志清楚，血压70/45mmHg，心率130次/分，呼吸急促，口唇发绀，右下肺叩浊音，可闻及管状呼吸音。血象：白细胞25.6×10⁹/L，中性粒细胞0.86×10⁹/L。X线示：右下肺大片炎症浸润阴影。其诊断是
A. 支气管肺炎
B. 葡萄球菌肺炎
C. 肺炎球菌肺炎
D. 肺脓肿
E. 休克性型肺炎

正确答案：E。休克性型肺炎

解析：休克型肺炎临床主要有肺部感染和休克的表现。多数患者有咳嗽、咳痰，全身不适；肺部体征多不典型。休克常突然发生，表现为：血压下降、面色苍白、四肢厥冷、冷汗淋漓、脉搏细速、口唇及肢体皮肤紫绀、尿少或无尿、表情淡漠、意识模糊不清、烦躁不安、或嗜睡甚至昏迷（E对）。支气管肺炎潜伏期2～3周，通常起病较缓慢。症状主要为乏力、咽痛、头痛、咳嗽、发热、食欲不振、腹泻、肌痛、耳痛等。咳嗽多为阵发性刺激性呛咳，咳少量黏液（A错）。葡萄球菌肺炎通常发生于糖尿病、血液病、艾滋病、肝病、营养不良等免疫功能受损的病人。院外感染起病较急，寒战，高热（体温多高达39℃～40℃），胸痛，咳嗽，咯脓痰，痰带血丝或呈脓血状，常有进行性呼吸困难，发绀（B错）。肺炎球菌肺炎症状为发热、胸痛、咯铁锈色痰。发病前常有受凉、淋雨、疲劳、醉酒、病毒感染等诱因；起病多急骤，高热，寒战，数小时内体温升至39℃～40℃，或呈稽留热，全身肌肉酸痛（C错）。肺脓肿是肺组织坏死形成的脓腔，它是由多种病原菌引起的肺部化脓性感染性疾病。早期为肺组织的感染性炎症，继而坏死、液化，由肉芽组织包裹形成脓肿。临床以高热、咳嗽、略大量脓臭痰为特征（D错）。